脏与脏之间主要表现为先后天互相资生关系的是指
A. 脾与心
B. 脾与肾
C. 肝与肾
D. 肝与脾
E. 肺与肾

正确答案：B。脾与肾

解析：脾主运化，化生气血，为后天之本；肾主藏精，是生命之本原，为先天之本。脾主运化，是脾气及脾阴脾阳协同作用的结果，但有赖于肾气及肾阴肾阳的资助和调节；肾藏精及其化生的元气，亦赖脾运化的水谷精微的不断充养和培育。后天与先天，相互资生，相互促进。先天温养激发后天，后天补充培育先天（B对）。心与脾（A错）的关系，主要表现在血液生成与运行上的相互为用、相互协同。肝与肾（C错）的关系，主要表现在"肝肾同源"，包括精血同源、藏泄互用以及阴阳互滋互制等内容；肝与脾（D错）的关系，主要表现在疏泄与运化的相互为用、藏血与统血的相互协调关系；肺与肾（E错）关系，主要表现在津液代谢、呼吸运动及阴阳互资三个方面。